下列有关延伸卡环的说法，不正确的是
A. 又称长臂卡环
B. 适用远中孤立的磨牙
C. 不应进入近缺隙松动基牙的倒凹
D. 松动基牙有固定夹板的保护作用
E. 卡环臂延伸至近缺隙基牙的相邻牙的倒凹区以获得固位

正确答案：B。适用远中孤立的磨牙

解析：长臂卡环：又称延伸卡环。用于近缺隙基牙松动或外形无倒凹无法获得足够固位力者。它是将卡环臂延伸至近缺隙基牙的相邻牙的倒凹区以获得固位，并对松动基牙有固定夹板的保护作用。该卡环任何部件不应进入近缺隙松动基牙的倒凹区。掌握“局部义齿固位体”知识点。